造成先天性甲状腺功能减低症最主要的原因是
A. 促甲状腺激素缺陷
B. 甲状腺素合成途径中酶缺乏
C. 碘缺乏
D. 甲状腺不发育或发育不全
E. 甲状腺或靶器官反应低下

正确答案：D。甲状腺不发育或发育不全

解析：先天性甲状腺功能减低症是由于甲状腺激素合成不足造成的一种疾病，甲状腺不发育、发育不全或异位是造成先天性甲低的最主要原因，约占90%（D对）。散发性先天性甲低的病因包括：1.甲状腺不发育或发育不全；2.甲状腺素合成障碍；3. 促甲状腺激素缺乏；4.甲状腺或靶器官反应低下；5.母亲服用抗甲状腺药物或母亲患自身免疫性疾病存在TSH抗体。促甲状腺激素缺陷（A错）、甲状腺素合成途径中酶缺乏（B错）、甲状腺或靶器官反应低下（E错）是先天性甲状腺功能减低症的病因，但不是最主要的原因。碘缺乏（八版内科学P683）（C错），是地方性甲状腺肿的最常见原因，并不是散发性先天性甲状腺功能减低症的病因。